医疗机构开展放射诊疗工作，须经什么部门许可以后方可开展
A. 所在医疗机构
B. 市级的卫生行政部门
C. 所在县级以上地方卫生行政部门的放射诊疗技术和医用辐射机构
D. 省级卫生行政部门
E. 当地县级的卫生部门

正确答案：C。所在县级以上地方卫生行政部门的放射诊疗技术和医用辐射机构

解析：医疗机构开展放射诊疗工作，应当具备与其开展的放射诊疗工作相适应的条件，经所在地县级以上地方卫生行政部门的放射诊疗技术和医用辐射机构许可。掌握“放射诊疗的概念分类及执业条件”知识点。